为了便于清洁，防止继发龋，邻面洞的龈缘与邻牙之间的间隙宽度至少应为
A. 0.5mm
B. 1mm
C. 1.5mm
D. 2mm
E. 2.5mm

正确答案：A。0.5mm

解析：本题考查窝洞预备的基本步骤。窝洞预备必须遵循便于清洁的原则，为了防止继发龋，邻面的颊舌洞缘应位于接触区以外的自洁区，龈缘与邻牙之间至少应为0.5mm（A对）宽的间隙，不必扩展到龈下。